在卡那霉素的分子中引入L-（-）氨基羟丁基侧链，所得到的药物对耐卡那霉素的金黄色葡萄球菌等细菌有显著的抑制作用，该药物是
A. 克拉霉素
B. 硫酸奈替米星
C. 阿米卡星
D. 硫酸依替米星
E. 盐酸米诺环素

正确答案：C。阿米卡星

解析：本题考查阿米卡星。阿米卡星（C对）是在卡那霉素的分子中引入L-（-）氨基羟丁基侧链，对耐卡那霉素的金黄色葡萄球菌等细菌有显著的抑制作用。克拉霉素（A错）是红霉素的衍生物。奈替米星（B错）、依替米星（D错）均未引入氨基羟丁基，而是改变卡那霉素的其它基团。米诺环素（E错）是四环素类抗生素。